药师应提供的药学服务内容包括
A. 用药咨询
B. 药品保障供应
C. 药品干预
D. 药物重整
E. 药物治疗管理

正确答案：A、C、D、E。用药咨询；药品干预；药物重整；药物治疗管理

解析：本题考查药学服务内容。药学服务包括用药咨询及患者用药教育（A对）、药学干预（C对）、药物重整（D对）、药物治疗管理（E对）。药品保障供应（B错）在最新版考试指导中未明确要求。